抑制甲状腺内酪氨酸的碘化和偶联的药物是
A. 阿卡波糖
B. 二甲双胍
C. 甲巯咪唑
D. 硫唑嘌呤
E. 格列本脲

正确答案：C。甲巯咪唑

解析：本题考查甲巯咪唑的作用机制。甲巯咪唑（C对）属于硫脲类抗甲状腺药，作用机制主要是抑制甲状腺内的过氧化物酶，进而抑制酪氨酸的碘化和偶联，抑制甲状腺激素的生物合成。二甲双胍（B错）为双胍类口服降糖药，通过促进组织对葡萄糖的摄取和利用，增加无氧酵解，抑制葡萄糖在肠道的吸收，抑制肝糖原异生，以及拮抗胰高血糖素，提高胰岛素的作用而降低血糖。阿卡波糖（A错）属于α-葡萄糖苷酶抑制剂，降糖机制是在小肠上皮刷状缘与碳水化合物竞争水解碳水化合物的糖苷水解酶，从而减慢碳水化合物水解及产生葡萄糖的速度并延缓葡萄糖的吸收。格列本脲（E错）是磺酰脲类降糖药，其降糖机制是：刺激胰岛B细胞释放胰岛素；增加门静脉胰岛素水平，抑制肝糖原分解和糖异生作用，使肝生成和输出葡萄糖减少，增加胰岛素与靶组织及受体的结合能力。巯唑嘌呤（D错）作用机制与巯嘌呤类似，可抑制DNA合成，为免疫抑制药。